表明具有特定保健功能的食品必须符合下列要求，但是除外
A. 其产品及说明书必须报国务院卫生行政部门审查批准
B. 其产品及说明书必须报国务院卫生行政部门审查备案
C. 不得有害于人体健康
D. 其产品说明书内容必须真实
E. 经产品的功能和成分必须与说明书相一致，不得有虚假

正确答案：B。其产品及说明书必须报国务院卫生行政部门审查备案